高血压脑出血最多见于
A. 基底节
B. 脑桥
C. 小脑
D. 大脑白质
E. 脑干

正确答案：A。基底节

解析：高血压脑出血常发生于基底节（A对）、内囊，其次为大脑白质（D错）、脑干（E错）和小脑（C错），脑桥（B错）出血是脑干出血的主要部位。由于基底节区域尤其是豆状核区域的供应动脉即豆纹动脉，从大脑中动脉呈直角分支，直接受到大脑中动脉压力较高的血流冲击和牵引，易致豆纹动脉破裂出血。